—期梅毒的主要症状，多于不洁性交后出现，其时间是
A. 1周左右
B. 2周左右
C. 3周左右
D. 4周左右
E. 5周左右

正确答案：C。3周左右

解析：一期梅毒常发生于不洁性交2~4周，题为单选题，故3周左右最为准确（C对）。